与氯霉素合用，药效增强的药物是
A. 苯巴比妥
B. 双香豆素
C. 庆大霉素
D. 别嘌醇
E. 甲苯磺丁脲

正确答案：B。双香豆素